在心动周期中，心室充盈主要依靠
A. 胸腔大静脉收缩
B. 心房收缩期射血
C. 心室舒张引起的低压抽吸
D. 胸膜腔负压抽吸
E. 心包的周期性扩张

正确答案：C。心室舒张引起的低压抽吸

解析：在心动周期中，心室的充盈期包括：快速充盈期、减慢充盈期和心房收缩期，其中快速充盈期进入心室的血液量约为心室总充盈量的2/3，心房收缩期射血（B错）约为心室总充盈量的25%。在快速充盈期，由于心室舒张引起的低压抽吸（C对），血液快速流入心室，使心室容积迅速增大。胸腔大静脉收缩（A错）、胸膜腔负压抽吸（D错）、心包的周期性扩张（E错）对心室充盈的影响不大。